女，28岁。右下肢骨折术后1天，气短伴咯血2小时。最可能的诊断是
A. 肺部感染
B. ARDS
C. 气胸
D. 胸膜炎
E. 肺血栓栓塞症

正确答案：E。肺血栓栓塞症

解析：病人下肢骨折术后出现气短、咯血症状，可能是由于下肢手术时形成血栓或脂肪栓子，经血液循环到达肺后，堵塞肺动脉主干或分支引起的肺血栓栓塞（E对）。肺血栓栓塞症的临床表现为：突发性呼吸困难、胸痛、咯血、晕厥等。肺部感染多表现为咳嗽、咳痰、发热等表现（A错）；ARDS即急性呼吸窘迫综合征，主要表现为进行型加重的呼吸困难、发绀，常伴有烦躁、焦虑、出汗等（B错）；气胸主要表现为呼吸困难、鼻翼扇动、口唇发绀、患侧呼吸音消失（C错）；胸膜炎主要表现为胸痛、胸闷、咳嗽、呼吸困难（D错）；这些疾病不会短时间内出现咯血。